有关黄疸的概念，哪种说法是错误的
A. 皮肤黏膜发黄即为黄疸
B. 皮肤黏膜发黄不一定有黄疸
C. 皮肤黏膜不黄不一定无黄疸
D. 黄疸多见于肝胆疾病
E. 胆汁淤积性黄疸时可有皮肤瘙痒

正确答案：A。皮肤黏膜发黄即为黄疸